五味子素含有
A. 联苯结构
B. 环辛烯结构
C. 四氢呋喃环结构
D. 苯代四氢萘结构
E. 双骈四氢呋喃环结构

正确答案：A、B。联苯结构；环辛烯结构

解析：本题考查的是联苯环辛烯型木脂素。五味子素含有联苯结构（A对）、环辛烯结构（B对）。联苯环辛烯型木脂素，这类木脂素的结构中既有联苯结构，又有联苯与侧链环合成的八元环状结构。至今已发现60多个化合物，其主要来源是五味子属植物，如五味子醇、五味子素等。单环氧木脂素是在简单木脂素基础上，还存在7-O-7’或9-O-9’或7-O-9’等形成的单环氧结构，即形成呋喃或四氢呋喃结构（C错）。环木脂素，在简单木脂素基础上，通过一个C₆-C₃单元的6位与另一个C₆-C₃单元的7位环合而成的木脂素，又称芳基萘类木脂素，可分为苯代四氢萘（D错）、苯代二氢萘及苯代萘等结构类型，自然界中以苯代四氢萘型居多。